滋补药宜
A. 睡前服
B. 饭前空腹服
C. 饭后服
D. 空腹服
E. 顿服

正确答案：B。饭前空腹服

解析：本题考查的是中药的服用方法。滋补药宜饭前空腹服（B对）。服药时间：药品治疗疾病有不同的特点，根据病情和药效，服药时间有饭前、饭后和早晚的区别。一般药物宜于饭后服（C错），滋补药宜饭前服，驱虫和泻下药宜空腹服（D错），安眠药宜睡前服（A错），抗疟药宜在发作前1～2小时服用，健胃药和对胃肠刺激性较大的药物宜饭后服。无论饭前或饭后服药，均应略有间隔，以免影响疗效。重病者不拘时间，迅速服用，有的也可煎汤代茶饮。昏迷的病人吞咽困难可用鼻饲法。总之，应根据病情需要和药物性能确定不同的服药时间，以便取得好的治疗效果。顿服（E错）属于服药次数。顿服是指将一剂药量一次服完。顿服法服药量大力峻，起效较快，多用于正气未虚的急重症治疗，年老体虚患者慎用此法。